男，25岁。夜间上腹痛2周，黑便2天，呕血伴头晕乏力4小时。最适宜应用的药物是
A. 雷尼替丁
B. 甲氰咪胍
C. 奥美拉唑
D. 多潘立酮
E. 枸橼酸泌钾

正确答案：C。奥美拉唑

解析：青年男性患者，夜间上腹痛（十二指肠球部溃疡表现为饥饿痛、夜间痛），有黑便、呕血，十二指肠球部溃疡出血可能大。该患者有头晕乏力表现，表明其为急性大量失血。对于消化性溃疡所致出血，止血措施主要有：抑制胃酸分泌；内镜治疗；介入治疗（P452）。抑制胃酸分泌首选PPI（质子泵抑制剂）如奥美拉唑静脉途径给药（C对）。雷尼替丁（A错）、甲氰咪胍（西咪替丁）（B错）是H₂受体拮抗剂，多潘立酮（D错）是促胃肠动力药，枸橼酸铋钾（E错）是胃黏膜保护剂，均不作为首选。